修复前口腔的一般处理有
A. 处理急性症状
B. 保证良好的口腔卫生
C. 拆除不良修复体
D. 治疗和控制龋病及牙周病
E. 以上都对

正确答案：E。以上都对

解析：本题考查修复前准备。修复前口腔的一般处理有：处理急性症状（A对）；保证良好的口腔卫生（B对）；拆除不良修复体（C对）；治疗和控制龋病及牙周病（D对）等内容。以上都对，选E。